患者男，8周岁，外伤致左上1冠折露髓，X线片示左上1根尖孔敞开，未见根折影像。患者就诊及时牙髓污染少，则应行
A. 根管牙胶尖充填
B. 根管碘仿充填
C. 根尖诱导成形术
D. 活髓切断术
E. 干髓术

正确答案：D。活髓切断术

解析：本题考查活髓切断术的适应证。患牙为根尖孔敞开的年轻恒牙，外伤露髓但牙髓污染少，可行活髓切断术（D对）以保存活髓，促使年轻恒牙的牙根继续发育。在牙根发育完成后，进行牙髓摘除术及根管治疗。因为年轻恒牙的牙根未发育完成，不能用根管牙胶尖充填（A错），因为直接牙胶充填会影响根尖孔闭合。且不能用根管碘仿充填（B错），碘仿充填不密合细菌易进入根管、不利于牙根的继续发育。根尖诱导成形术（C错）适用于牙髓病变已波及根髓的年轻恒牙，此患者冠髓有炎症根髓尚有活力，没有根尖周病，所以不采用此方法治疗患牙。干髓术（E错）用于治疗乳牙牙髓炎，不适用于尚有部分活髓的年轻恒牙。